可使下颌骨上提并退后的肌是
A. 颞肌
B. 咬肌
C. 颧肌
D. 翼内肌
E. 翼外肌

正确答案：A。颞肌

解析：颞肌（A对）可使下颌骨上提并退后。咬肌（B错）上提下颌骨，同时向前牵引下颌骨。颧肌（C错）提上唇与口角。翼内肌（D错）上提下颌骨，并使其向前运动。翼外肌（E错）两侧同时收缩作张口运动，一侧收缩则使下颌移向对侧。